关于颌面部后天梅毒的表现叙述错误的是
A. 梅毒瘤
B. 梅毒疹
C. 口唇下疳
D. 树胶样肿
E. 哈钦森牙

正确答案：E。哈钦森牙

解析：后天梅毒依病程主要表现有三点，即口唇下疳、梅毒疹和树胶样肿（梅毒瘤）。梅毒性间质性角膜炎致角膜混浊、第Ⅷ对脑神经损害所致神经聋以及哈钦森牙，被称为先天性梅毒的哈钦森三征。掌握“颌面部梅毒”知识点。